男，45岁。酗酒后8小时出现中上腹疼痛，放射至两侧腰部，伴恶心、呕吐。体检腹部有压痛、肌紧张及两侧腰腹部出现蓝棕色斑，血压75／55mmHg，脉搏110次/分。下列检查应首先选择
A. 血、尿常规
B. 尿淀粉酶测定
C. 胸腹部X线平片
D. 血清淀粉酶测定
E. 腹部B型超声检查

正确答案：D。血清淀粉酶测定

解析：急性胰腺炎的实验室检查中，胰酶的测定是最常用的诊断方法，其中血清淀粉酶在发病数小时开始升高，24小时达高峰，4～5天后逐渐降至正常（D对），是首选的检查方法。而尿淀粉酶在24小时才开始升高，48小时达到高峰（B错），在本题所述的8小时内还未升高，所以排除此选项。血、尿常规（A错）虽对诊断有帮助，但缺乏特异性，故不作首选。腹部超声经济简便易行，但由于上腹部胃肠气体的干扰，可影响诊断的准确性，而不作为首先检查（E错）。胸腹部X线平片检查对胰腺炎诊断价值不大（C错）。